男，55岁，工程师。因膀胱癌入院准备接受手术治疗。在术前准备期间，患者一方面希望尽快恢复健康而配合各种检查和治疗，另一方面又担心自己主持的工程项目出问题而自行离院回单位开会。这种患者角色的状态属于
A. 角色行为强化
B. 角色行为异常
C. 角色行为适应
D. 角色行为缺如
E. 角色行为冲突

正确答案：E。角色行为冲突

解析：病人角色适应不良（B错）是指病人不能顺利地完成角色转变的过程。常见的角色适应不良有角色行为缺如、角色行为冲突、角色行为减退、角色行为强化、角色行为异常。角色行为冲突（E对）是指当多种社会地位和多种角色集于一人时，在其自身内部产生的冲突。题中患者病前的社会角色工程师，生病后需要休息和静养，但病人还是按照自己以往的习惯行事，自行离院回单位开会，不能适应病人角色的要求，这是角色行为冲突。冲突角色行为缺如（D错）是指病人未能进入病人角色，不承认自己是病人。角色行为强化（A错）是指个体“安于”病人角色的现状，角色的行为与其躯体症状不相吻合，过分地对自我能力表示怀疑、失望和忧虑，行为上表现出较强的退缩和依赖性。